腹股沟淋巴结不可引流以下哪个区域的淋巴
A. 下肢
B. 下腹壁
C. 外生殖器
D. 臀部
E. 腹部

正确答案：E。腹部

解析：腹股沟淋巴结分为腹股沟浅淋巴结和腹股沟深淋巴结，腹股沟浅淋巴结可以引流腹前外侧壁下部（B对）、臀部（D对）、会阴（C对）、子宫底和除了足外侧缘和小腿后外侧的下肢浅淋巴管（A对），腹股沟深淋巴结引流大腿深部结构和会阴处淋巴，不引流腹部（E错）的淋巴。